《中华人民共和国药品管理法》规定制定医疗保险定点医疗机构常用药品价格公布办法的部门是
A. 国务院药品监督管理部门
B. 国务院卫生行政部门
C. 国务院劳动和社会保障部门
D. 省、自治区、直辖市人民政府药品监督管理部门
E. 省、自治区、直辖市人民政府卫生行政部门

正确答案：B。国务院卫生行政部门

解析：本题考查药品价格。制定医疗保险定点医疗机构常用药品价格公布办法的部门是国务院卫生行政部门（B对）。医疗机构应当向患者提供所用药品的价格清单，按照规定如实公布其常用药品的价格，加强合理用药管理。具体办法由国务院卫生健康主管部门制定。